药物分子与机体生物大分子相互作用方式有共价键合和非共价键合两大类，以共价键合方式与生物大分子作用的药物是
A. 美法仑
B. 美洛昔康
C. 雌二醇
D. 乙胺丁醇
E. 卡托普利

正确答案：A。美法仑

解析：本题考查药物与生物大分子相互作用的方式。美法仑（A对）是烷化剂的一种，以共价键合方式与生物大分子作用。共价键合是一种不可逆的结合形式，与发生的有机合成反应相类似。共价键键合类型多发生在化学治疗药物的作用机制上，如烷化剂类抗肿瘤药物，与DNA中鸟嘌呤基形成共价结合键，产生细胞毒活性。美法仑的烷基化部分是β-氯乙胺，载体部分是L-苯丙氨酸部分，L-苯丙氨酸为人体必需氨基酸，是一个良好的载体。美法仑较其对映体具有更高的活性。